急性阑尾炎闭孔内肌试验阳性提示阑尾的位置是
A. 盲肠后位
B. 盆位
C. 盲肠外位
D. 回肠前位
E. 回肠后位

正确答案：B。盆位

解析：阑尾尖端指向有回肠前位、盆位、盲肠后位、盲肠下位、盲肠外侧位和回肠后位六种类型。盆位指阑尾跨腰大肌前面入盆腔，尖端可触及闭孔内肌或盆腔脏器，炎症时可刺激腰大肌（伸髋时疼痛）或闭孔内肌（屈髋内旋时疼痛）。因此，闭孔内肌试验阳性即病人仰卧，右髋和右大腿屈曲，被动内旋时右下腹疼痛，提示阑尾的位置是盆位（B对）。腰大肌试验阳性时，提示阑尾炎位置较深或在盲肠后位靠近腰大肌处，或炎症已波及腰大肌（A错）。而阑尾位于盲肠外位（C错）、回肠前位（D错）和回肠后位（E错）时，较难通过辅助试验判断阑尾的位置。